患儿4个月半，接下来要接种的疫苗是
A. 卡介苗
B. 乙肝
C. 百白破第一针
D. 百白破第二针
E. 百白破第三针

正确答案：E。百白破第三针

解析：患儿4个月半，接下来要接种的疫苗是百白破第三针（E对），百白破第三针接种的时间为五个月，该患儿4个月半马上5个月，所以应接种百白破第三针。卡介苗（A错）接种的时间为刚出生时。乙肝（B错）疫苗接种的时间为出生时、生后一个月及六个月。百白破第一针（C错）和第二针（D错）接种的时间分别是生后3个月和4个月。